关于中成药的说法，错误的是
A. 中成药的质量应当符合《中国药典》或者省级标准
B. 中成药通用名称应当科学、明确、简短，不易产生歧义和误导
C. 国家鼓励运用现代科学技术研究开发传统中成药
D. 中成药应当由依法取得《药品生产许可证》的企业生产

正确答案：A。中成药的质量应当符合《中国药典》或者省级标准

解析：本题考查中药饮片生产管理。《药品管理法》规定，中药饮片应当按照国家药品标准炮制；国家药品标准没有规定的，应当按照省（区、市）人民政府药品监督管理部门制定的炮制规范炮制（A错，为本题正确答案）。中成药通用名称应科学、明确、简短、不易产生歧义和误导，避免使用生涩用语（B对）。鼓励运用现代科学技术研究开发传统中成药（C对），鼓励发挥中药传统剂型优势研制中药新药，加强中药质量控制。中成药应由依法取得药品生产许可证的企业生产（D对），质量符合国家药品标准，包装、标签、说明书符合《药品管理法》规定。